（牙合）支托可放在
A. 基牙近远中边缘嵴上
B. 上颌磨牙颊沟处
C. 下颌磨牙舌沟处
D. 前牙舌隆突处
E. 以上都对

正确答案：E。以上都对

解析：（牙合）支托的位置：（牙合）支托应在基牙的近远中边缘嵴上。如果因咬合过紧而不易获得支托位置时，可放在上颌磨牙的颊沟处，或放在下颌磨牙的舌沟处。尖牙的舌隆突上也可放（牙合）支托，如尖牙无明显舌隆突或有龋坏，可先用3/4冠或全冠修复尖牙外形，并留出（牙合）支托凹，然后在凹内放置（牙合）支托。也可放在基牙的切缘上（切支托）。掌握“局部义齿人工牙及基托”知识点。